在中医的常用治法中属于温法的是
A. 清热解毒
B. 消疮散结
C. 表里双解
D. 回阳救逆
E. 消痰祛水

正确答案：D。回阳救逆

解析：本题考查的是治法。在中医的常用治法中属于温法的是回阳救逆（D对）。治法分为“八法”，具体为：1.汗法：又称“解表法”，是针对外邪袭表、邪在肺卫病机拟定的治法。汗法主要适用于表证，通过发汗解表以祛邪；“汗之”还有和阴阳、通表里、调脏腑的作用。汗法由于感受外邪有风寒、风热等不同，以及体质的差异，可分为辛温解表法、辛凉解表法、透疹解表法、扶正解表法等。2.吐法：又称“涌吐法”，是针对停蓄在咽喉、胸膈、胃脘的痰涎、宿食、毒物而拟定的治法。适用于中风、癫狂、喉痹之痰涎壅盛、阻塞咽喉；或宿食停滞胃脘；或误食毒物，为时不久，毒物尚留胃中者等。吐法根据体质强弱、病情轻重等情况，可分为峻吐法、缓吐法等。3.下法：又称“泻下法”，是运用具有泻下作用的药物，通泻大便，逐邪外出的治疗方法。下法适用于胃肠实热内结或寒积、宿食积滞、水饮、痰湿、瘀血等停留体内的里实证。下法针对里实证病机有热结、寒结、燥结和水结等的不同，以及体质有虚实的差异，可分为寒下法、温下法、润下法、泻下逐水法、攻补兼施法五种。4.和法：又称“和解法”，是通过调和、和解的方法，使半表半里之邪，或脏腑、阴阳、表里失和之证得以解除（C错）的治法。和法原为和解少阳而设，适用于病在半表半里的少阳证。后世医家在和解少阳法的基础上，扩展出调和肝脾法、调和肠胃法等。5.温法：又称“温里法”，是使用温热药治疗寒证的治法。温里法适用于里寒证。由于里寒证病情的不同，温里法又分为温中祛寒法、回阳救逆法、温经散寒法三种。6.清法：又称“清热法”，是运用寒凉性质的方药，通过其泻火、解毒、凉血等作用，以解除热邪的治法。清法适用于里热证。由于热邪有虚实、病位及间夹他邪的不同，清热法又分为清热泻火法、清热凉血法、清热燥湿法、清热解毒（A错）法、清虚热法等。7.消法：又称“消导法”，是消散体内有形积滞以祛除病邪的治法。运用范围比较广泛，凡由气、血、痰、湿、食等壅滞而形成的积滞痞块（BE错），均可用消法。由于致病原因和病情的不同，消法主要分为消食导滞、消痞散积、软坚散结等。8.补法：又称“补益法”，是用补益药物补养人体气血阴阳不足、改善衰弱状态，治疗各种虚证的治法。补法适用于脏腑、气血、阴阳等各种虚证。由于虚证有气虚、血虚、阴虚、阳虚病的不同，补法可分为补气法、补血法、补阴法、补阳法等。